男，20岁，8月5日来诊。进食海鲜3小时后出现腹泻，呕吐伴轻微腹痛，大便为稀水样，共便20次。查体：烦躁不安，脱水貌，双侧腓肠肌痉挛。粪常规可见少量白细胞，未见红细胞。该患者最可能的诊断是：
A. 霍乱
B. 细菌性痢疾
C. 细菌性食物中毒
D. 急性胃肠炎
E. 胃肠型感冒

正确答案：A。霍乱

解析：患者8月份发病，进食海鲜后突发腹泻、呕吐，大便为稀水样，次数多，腓肠肌痉挛，烦躁不安，脱水貌，应诊断为霍乱（A对）。菌痢（P178）（B错）多有不洁饮食史，常表现为腹痛腹泻，排黏液脓血便以及里急后重等。细菌性食物中毒（P157）（C错）好发于夏秋季，集体暴发起病，以急性胃肠炎为主，病程较短。急性胃肠炎（P165）（D错）常以胃肠道症状为主，轻重不一，一般不出现腓肠肌痉挛。胃肠型感冒（P57）（E错）是感冒的一种，有呕吐、腹泻等消化道症状，一般不伴烦躁不安，脱水貌，双侧腓肠肌痉挛。